生活污染来源不包括
A. 生活污水
B. 垃圾和人畜粪便
C. 工业三废和汽车废气
D. 烹调油烟和香烟烟雾
E. 装饰材料的挥发性有机物

正确答案：C。工业三废和汽车废气

解析：本题考查生活污染来源。生活污染源是指源于社会生活功能的各种过程而向环境排放污染物或者对环境产生不良影响的场所、设施、装置以及其他污染发生源。生活污水（A对）；垃圾和人畜粪便（B对）；烹调油烟和香烟烟雾（D对）；装饰材料的挥发性有机物（E对）均属于生活污染来源。工业三废（C错，为本题正确答案）是指工业生产过程中排出的废气、废水、废渣，不是生活污染来源。